蓝斑-去甲肾上腺素能神经元要与哪些部位有往返联系？
A. 杏仁复合体
B. 海马结构
C. 边缘中脑
D. 边缘皮层
E. 以上都是

正确答案：E。以上都是

解析：杏仁复合体（A对）、海马结构（B对）、边缘中脑（C对）、边缘皮层（D对，故E为本题正确答案）蓝斑-去甲肾上腺素能神经元有往返联系。